脏腑功能低下或衰退形成的病证是
A. 气逆
B. 气滞
C. 气陷
D. 气虚
E. 气脱

正确答案：D。气虚

解析：气虚指一身之气不足，而表现出相应功能减退的病机变化（D对）。气逆指气升之太过，或降之不及，以脏腑之气逆上为特征的病机变化（A错）。气滞指气的运行不畅，郁滞不通的病机变化（B错）。气陷指气的上升不足，或下降太过，以气虚升举无力而下陷为特征的病机变化（C错）。气脱指气不内守，大量向外脱失，以致机体功能突然衰竭的病机变化（E错）。